飞沫传播时飞沫的直径是
A. ＞2μm
B. ＞5μm
C. ＞10μm
D. ＞15μm
E. ＞20μm

正确答案：B。＞5μm

解析：本题考查飞沫传播。飞沫传播时飞沫的直径是＞5μm（B对）。飞沫传播是指传染源产生带有微生物的飞沫（＞5μm）在空气中移行短距离后移植到宿主的上呼吸道而导致的传播。是一种近距离（1m以内）传播。